复方硫黄临床常用的剂型是
A. 洗剂
B. 涂剂
C. 涂膜剂
D. 贴膏剂
E. 搽剂

正确答案：A。洗剂

解析：本题考查洗剂。复方硫黄临床常用的剂型是洗剂（A对）；涂剂（B错）系指用消毒纱布或棉球等柔软的物料蘸取涂于皮肤或口腔喉部黏膜的液体制剂；涂膜剂（C错）系涂布患处后形成薄膜的外用液体制剂；贴膏剂（D错）系指供皮肤贴敷，可产生局部或全身作用的一类片状外用制剂；搽剂（E错）系指供无破损的皮肤揉搽用的制剂。